对无功能障碍的关节弹响，可嘱以关节保护措施、局部湿热敷。复位（牙合）板治疗可减轻或消除关节弹响。此为哪种TMD的治疗原则
A. 翼外肌功能亢进
B. 翼外肌痉挛
C. 不可复性关节盘移位
D. 可复性关节盘移位
E. 肌筋膜痛

正确答案：D。可复性关节盘移位

解析：可复性关节盘移位的治疗方法：对无功能障碍的关节弹响，可嘱以关节保护措施、局部湿热敷。复位（牙合）板治疗可减轻或消除关节弹响。如伴有翼外肌痉挛或滑膜炎，则应进行相关对症治疗。对于无功能障碍的可复性前移位，无需进行外科手术治疗。掌握“颞下颌关节紊乱”知识点。